腹痛的主要病因病机不包括
A. 感受寒邪
B. 气阴亏虚
C. 乳食积滞
D. 脏腑虚冷
E. 气滞血瘀

正确答案：B。气阴亏虚

解析：小儿脾胃薄弱，经脉未盛，易为各种病邪干扰。六腑以通降为顺，经脉以流通为畅，若感受寒邪、乳食停滞、脾胃虚寒、情志刺激、外伤等，皆可使脾胃运化失司，肠腑气机壅滞，不通则痛，而出现腹痛，其主要的病机为感受寒邪（A对）、乳食积滞（C对）、脏腑虚冷（D对）和气滞血瘀（E对）。气阴亏虚多为胃痛、咳嗽等的病因病机（B错，为本题正确答案）。